使用一种新疗法可减少某病的死亡人数，但不能使该病治愈，则会发生
A. 该病的发病率减少
B. 该病的发病率增加
C. 该病的患病率减少
D. 该病的患病率增加
E. 只减少发病率不减少患病率

正确答案：D。该病的患病率增加